错误的是
A. 硬膜下隙较蛛网膜下隙宽阔
B. 软膜与蛛网膜间的间隙称蛛网膜下隙
C. 软膜与蛛网膜间的间隙较宽阔
D. 软膜薄而富有血管，可深入脑、脊髓的沟裂中
E. 无

正确答案：A。硬膜下隙较蛛网膜下隙宽阔

解析：在硬脊膜与脊髓蛛网膜之间有潜在的硬膜下隙，在脊髓蛛网膜与软脊膜之间有较宽阔的蛛网膜下隙。所以蛛网膜下隙较硬膜下隙宽阔（A错，为本题正确答案）。软膜薄而富有血管，可深入脑、脊髓的沟裂中（D对）。